女，22岁。一年来反复洗手、洗衣物，总担心洗不干净或者碰到脏东西。明知道担心过分却不能控制自己。为此不能正常工作和做家务，苦恼万分。该患者最可能的诊断是
A. 强迫障碍
B. 疑病障碍
C. 广泛性焦虑障碍
D. 恐惧性焦虑障碍
E. 妄想性障碍

正确答案：A。强迫障碍

解析：女，22岁。一年来反复洗手、洗衣物，总担心洗不干净或者碰到脏东西。明知道行为过分却不能自己。为此不能正常工作和做家务，苦恼万分。该患者认为总担心洗不干净或者碰到脏东西没有必要或不正常，违反了自己的意愿，无法摆脱，为此感到焦虑和痛苦，因此最可能的诊断是强迫障碍（A对），这是一种以反复出现的强迫观念、强迫冲动或强迫行为等为主要临床表现的精神疾病。疑病障碍（B错）是一种以担心或相信患有一种或多种严重躯体疾病的持久的先占观念为特征的精神障碍。该患者不表现在对躯体疾病的担忧上，所以不选。广泛性焦虑障碍（C错）是一种以焦虑为主要临床表现的精神障碍，患者常会有不明原因的提心吊胆、紧张不安，显著的自主神经功能紊乱症状、肌肉紧张及运动性不安。恐惧性焦虑障碍（D错）的特点之一是突发惊恐，而该患者无恐惧性心理表现，所以不选。妄想性障碍（E错）主要出现与妄想主题相一致的各种形式的感知觉障碍以情绪、态度和行为反应，而该患者无妄想。